下列辅料中，属于抗氧剂的有
A. 焦亚硫酸钠
B. 硫代硫酸钠
C. 依地酸二钠
D. 生育酚
E. 亚硫酸氢钠

正确答案：A、B、D、E。焦亚硫酸钠；硫代硫酸钠；生育酚；亚硫酸氢钠

解析：本题考查抗氧剂。下列辅料中，属于抗氧剂的有焦亚硫酸钠（A对）、硫代硫酸钠（B对）、亚硫酸氢钠（E对）。常用的水溶性抗氧剂有亚硫酸钠、亚硫酸氢钠、
焦亚硫酸钠、硫代硫酸钠、硫脲、维生素C、半胱氨酸等。常用的油溶性抗氧剂有叔丁基对羟基茴香醚 （BHA）、2，6-二叔丁基对甲酚(BHT) 、维生素E（D错）等。依地酸二钠（C错）为金属离子络合剂。